在环境污染物质，一次污染物是指
A. 从污染物排入环境后，理化性质发生了改变的污染物
B. 从污染物直接排入环境后，理化性质未发生改变的污染物
C. 从污染物排入环境后，其毒性增大的污染物
D. 多个污染源同时排出的同一类污染物
E. 多种环境介质中都存在同一类污染物

正确答案：B。从污染物直接排入环境后，理化性质未发生改变的污染物

解析：考察一次污染物的概念。一次污染物是指从污染源直接进入环境，其理化性质未发生改变的污染物，主要有二氧化硫、一氧化碳、氮氧化物、二氧化氮、颗粒物（飘尘、降尘、油烟等）、氨气、及含氧、氮、氯、硫有机化合物以及放射性物质等。从污染物直接排入环境后，理化性质未发生改变的污染物（B对）是一次污染物。